关于铁蛋白，正确的描述是
A. 血红蛋白的另一种名称
B. 诊断缺铁性贫血的最理想指标
C. 铁在体内的一种储存形式
D. 铁在体内的转运形式
E. 构成细胞色素C的基本单位

正确答案：C。铁在体内的一种储存形式